消食化积力强，临床常用于食积泄泻的饮片是
A. 炒六神曲
B. 麦芽
C. 炒麦芽
D. 麸炒六神曲
E. 焦六神曲

正确答案：E。焦六神曲

解析：本题考查的是六神曲的炮制作用。消食化积力强，临床常用于食积泄泻的饮片是焦六神曲（E对）。六神曲：【炮制作用】六神曲味甘、辛，性温。入脾、胃经。①生六神曲健脾开胃，并有发散作用。②炒神曲（A错）健脾悦胃功能增强，发散作用减少。③麸炒六神曲（D错）具有甘香气，以醒脾和胃为主。用于食积不化，脘腹胀满，不思饮食，肠鸣泄泻。④焦六神曲消食化积力强，以治食积泄泻为主。炒麦芽（C错）为麦芽（B错）的炮制品。麦芽：【炮制作用】麦芽味甘，性平。归脾、胃经。具有消食和胃、疏肝通乳的功能。用于消化不良，乳汁淤积，乳癖。①炒麦芽偏温而气香，具有行气、消食、回乳之功。②焦麦芽性偏温而味微甘、微涩，增强了消食化滞、止泻的作用。